关于流行病学下列哪条是不正确的
A. 它是医学的基础学科
B. 它以个体为研究对象
C. 它能为卫生决策提供依据
D. 它可以研究疾病的自然史

正确答案：B。它以个体为研究对象

解析：本题考查流行病学的应用。流行病学是医学的基础学科（A对），它是以群体（B错，为本题正确答案）为特征，研究人群中疾病健康状况的分布及影响因素，并研究防制疾病及促进健康的策略和措施的科学。流行病学可广泛应用于：疾病预防和健康促进；疾病的监测；疾病病因和危险因素的研究；疾病的自然史（D对）；疾病防治的效果评价，为卫生决策提供依据（C对）。